电离辐射对生物体的作用叙述不正确的是
A. 是物理和化学变化的时间过程
B. 可造成生物大分子的直接损伤
C. 可引起生物大分子的氧化损伤
D. 引起的损伤可有远期遗传效应
E. 生物学效应不受射线剂量影响

正确答案：E。生物学效应不受射线剂量影响